下列各种类型急性白血病中，哪一类最常发生中枢神经系统白血病
A. 急性粒细胞白血病
B. 急性单核细胞白血病
C. 急性淋巴细胞白血病
D. 急性粒单核细胞性白血病
E. 红白血病

正确答案：C。急性淋巴细胞白血病

解析：各种类型急性白血病中，急性淋巴细胞白血病（C对）最常发生中枢神经系统白血病。急性粒细胞白血病（P571）（A错）常发生绿色瘤（粒细胞肉瘤）；急性单核细胞白血病（P571）（B错）、急性粒单核细胞型白血病（P571）（D错）最常发生牙龈增生、肿胀；九版内科学未明确说明红白血病（E错）的常见症状。